鸡内金味甘，性平，除能治疗小儿疳积外，还能治疗
A. 食积便秘
B. 遗精遗尿
C. 虫积便秘
D. 乳房胀痛
E. 泻痢腹痛

正确答案：B。遗精遗尿

解析：本题考查的是鸡内金的主治病证。鸡内金味甘，性平，除能治疗小儿疳积外，还能治疗遗精遗尿（B对）。鸡内金：【主治病证】（1）食积不化，消化不良，小儿疳积。（2）遗尿，遗精。（3）泌尿系或肝胆结石症。枳实：【主治病证】（1）食积便秘（A错）胀痛。（2）泻痢里急后重。（3）痰湿阻滞之胸脘痞满，痰滞胸痹证。（4）胃扩张，胃下垂，脱肛，子宫脱垂。榧子：【主治病证】（1）虫积腹痛。（2）肠燥便秘（C错）。（3）肺燥咳嗽。玫瑰花：【主治病证】（1）肝胃气滞之胸胁脘腹胀痛。（2）肝郁血瘀之月经不调、乳房胀痛（D错）。（3）外伤肿痛。青木香：【主治病证】（1）肝胃气滞之胸胁胀满、脘腹疼痛。（2）痧胀腹痛，泻痢腹痛（E错）。（3）蛇虫咬伤，痈肿疔毒，湿疮。